男，26岁，5天来鼻及牙龈出血，皮肤瘀斑。血红蛋白55g/L，白细胞10.0×10⁹/L，血小板16×10⁹/L。骨髓增生极度活跃，绝大多数细胞呈清一色，胞浆内有大小不等颗粒及成堆Auer小体，过氧化酶染色强阳性。最可能的诊断是
A. 急性早幼粒细胞性白血病
B. 急性淋巴细胞性白血病
C. 急性粒-单核细胞性白血病
D. 慢性粒细胞性白血病急变
E. 急性单核细胞性白血病

正确答案：A。急性早幼粒细胞性白血病

解析：患者青年男性，5天来鼻及牙龈出血，皮肤瘀斑（出血表现），血红蛋白55g（成年男性Hb正常值120～160g/L），提示贫血，白细胞10.0×10⁹/L（正常4～10×10⁹/L），血小板16×10⁹/L（正常100～300×10⁹/L）明显减少，骨髓增生极度活跃，绝大多数细胞呈清一色，胞浆有大小不等颗粒（早幼粒细胞的特点）及成堆棒状小体（见于急性非淋巴细胞白血病），髓过氧化物酶染色强阳性（见于急性粒细胞白血病、急性早幼粒细胞白血病），故患者最可能的诊断为急性早幼粒细胞白血病（A对）。急性淋巴细胞性白血病（B错）常有淋巴结肿大，细胞胞浆内无棒状小体，髓过氧化物酶染色阴性；急性粒-单核细胞白血病（C错）髓过氧化物酶染色可呈阳性但细胞胞浆内无颗粒；慢性粒细胞白血病急变（D错）病程长，脾肿大显著；急性单核细胞白血病（E错）虽可见棒状小体，但过氧化酶染色弱阳性或阴性，常出现牙龈增生，皮肤损害。